结核病的传播方式主要是
A. 接触结核病病人的排泄物
B. 血液传播
C. 尘埃传播
D. 飞沫核
E. 直径在10μm以上的飞沫

正确答案：D。飞沫核